膀胱经的合穴是
A. 上巨虚
B. 下巨虚
C. 足三里
D. 委阳
E. 委中

正确答案：E。委中

解析：上巨虚为大肠下合穴（A错）。下巨虚为小肠下合穴（B错）。足三里为胃经的合穴和胃下合穴（C错）。委阳为三焦下合穴（D错）。委中为膀胱经的合穴和膀胱下合穴（E对）。